执业医师资格考试制度规定的条件之一是
A. 经相应职称评审发给执业证书，取得相应的专业职称系列资格
B. 经医学本科学历教育，具备申请医师资格考试的基本条件
C. 经资格认定取得执业证书，取得开展诊疗活动资格
D. 经注册取得执业证书才具备合法行医条件
E. 申请经批准发给执业证书，具备医师行业准入资格

正确答案：B。经医学本科学历教育，具备申请医师资格考试的基本条件

解析：执业医师资格考试制度规定的条件之一是经医学本科学历教育，具备申请医师资格考试的基本条件。（一）参加执业医师资格考试的条件 根据《执业医师法》和相关规定，具有下列条件之一的，可以参加执业医师资格考试：①具有高等学医学专业本科以上学历（是指国务院教育行政部门认可的各类高等学校医学专业本科以上学历） 在执业医师指导下，在医疗、预防、保健机构中试用期满1年（B对）。